同服碳酸氢钠，防止胃酸对其分解的药物是
A. 磺胺嘧啶
B. 链霉素
C. 红霉素
D. 苯巴比妥
E. 水杨酸钠

正确答案：C。红霉素

解析：本题考查药物的联合应用。同服碳酸氢钠，防止胃酸对其分解的药物是红霉素（C对）。红霉素在酸性环境中会被破坏降效，碳酸氢钠为碱性，能够中和胃酸。